《素问·上古天真论》“阳明脉衰，面始焦”是女子哪个阶段的生理特点
A. 三七
B. 四七
C. 五七
D. 六七
E. 七七

正确答案：C。五七

解析：女子三十五岁时，阳明经脉气血渐衰弱，面部开始憔悴，头发也开始脱落（C对）；女子二十一岁时，肾气充满，智齿生出，发育健全（A错）；女子二十八岁时，筋骨强健有力，头发的生长达到最茂盛的阶段，此时身体最为强壮（B错）；女子四十二岁时，三阳经脉气血衰弱，面部憔悴无华，头发开始变白（D错）；女子四十九岁时，任脉气血虚弱，太冲脉的气血衰少，天葵枯竭，月经断绝，所以形体衰老，失去了生育能力（E错）。